口服脊髓灰质炎糖丸适宜的时间是生后
A. 3个月，4个月，5个月
B. 2个月，3个月，4个月
C. 1个月，2个月，3个月
D. 出生时，1个月，2个月
E. 4个月，5个月，6个月

正确答案：B。2个月，3个月，4个月

解析：脊髓灰质炎【预防】1.主动免疫对所有小儿均应口服脊髓灰质炎减毒活疫苗糖丸进行主动免疫。基础免疫自出生后2月龄婴儿开始，连服3剂，每次间隔1个月（B对），4岁时加强免疫一次。